主含木脂素类成分的是
A. 苦杏仁
B. 五味子
C. 葛根
D. 延胡索
E. 颠茄

正确答案：B。五味子

解析：本题考查的是五味子的化学成分。主含木脂素类成分的是五味子（B对）。五味子含木脂素较多，约为5%，近年来从其果实中分得了一系列联苯环辛烯型木质素。《中国药典》采用高效液相色谱法测定药材中五味子醇甲的含量，要求不得少于0.40%。苦杏仁（A错）主要含有苦杏仁苷，《中国药典》以苦杏仁苷为指标成分进行含量测定，规定含量不得少于3.0%。葛根（C错）含异黄酮类化合物，主要成分有大豆素、大豆苷、大豆素-7，4'-二葡萄糖苷及葛根素、葛根素-7-木糖苷。《中国药典》以葛根素为指标成分进行含量测定，要求含葛根素不得少于2.4%。延胡索（D错）与颠茄（E错）主含生物碱。生物碱类主要分布于植物界，在动物界中少有发现。生物碱绝大多数存在于双子叶植物中，已知有50多个科的120多个属中存在生物碱。与中药有关的典型的科有毛茛科（黄连属黄连，乌头属乌头、附子）、防己科（汉防己、北豆根）、罂粟科（罂粟、延胡索）、茄科（曼陀罗属洋金花、颠茄属颠茄、莨菪属莨菪）、马钱科（马钱子）、小檗科（三颗针）、豆科（苦参属苦参、槐属苦豆子）等。单子叶植物也有少数科属存在生物碱，如石蒜科、百合科（贝母属的川贝母、浙贝母）、兰科等。少数裸子植物如麻黄科、红豆杉科、三尖杉科和松柏科也存在生物碱。低等植物中仅发现极个别的存在生物碱，如烟碱存在于蕨类植物中，麦角生物碱存在于菌类植物中。地衣、苔藓类植物中仅发现少数简单的吲哚类生物碱。藻类、水生类植物中未发现生物碱。